患者，女，38岁。患白细胞减少症。面色无华，疲倦无力，头晕目眩，少寐多梦，纳呆食少，便溏，舌淡，苔白，脉细弱。治疗应首先考虑的方剂是
A. 归脾汤
B. 六味地黄丸
C. 生脉散
D. 黄芪建中汤
E. 当归补血汤

正确答案：A。归脾汤

解析：患者患白细胞减少症，血虚不能上荣于面部，故见面色无华；气虚不能推动则疲倦无力；肝血亏虚不能上养头目，故见头晕目眩；血不养心，心神不宁则少寐多梦；脾虚失于运化故见纳呆食少，便溏；肝血亏虚，妇女下焦失于充养故见月经失调，舌淡，苔白；血虚气少，脉不充盈故见脉细弱，可诊断为气血两虚证，治法为益气养血，方药选用归脾汤加减（A对）。六味地黄丸（B错）可以滋补肝肾，用于治疗白细胞减少症肝肾阴虚证。生脉散（C错）可以益气养阴，用于治疗白细胞减少症气阴两虚证。黄芪建中汤（D错）可以温补脾肾，用于治疗白细胞减少症脾肾亏虚证。当归补血汤（E错）可以补气养血，用于治疗缺铁性贫血脾胃虚弱证。